系一类含有14、15和16元大环内酯环的具有抗菌作用的抗生素
A. 利福平
B. 头孢类抗生素
C. 氨基糖苷类抗生素
D. 磺胺类抗生素
E. 大环内酯类抗生素

正确答案：E。大环内酯类抗生素

解析：大环内酯类抗生素系一类含有14、15和16元大环内酯环的具有抗菌作用的抗生素。掌握“红霉素及林可霉素”知识点。